男，64岁。乏力、消瘦、大便次数增多4个月。查体：面色苍白，腹平软，右侧腹部可触及直径约5cm包块。实验室检查：Hb80g/L，粪隐血（+）。最可能的诊断是
A. 十二指肠癌
B. 胆囊癌
C. 阑尾类癌
D. 升结肠癌
E. 胰头癌

正确答案：D。升结肠癌

解析：老年患者，乏力、消瘦、大便次数增多（结肠癌的典型临床表现），查体：面色苍白，腹平软，右侧腹部可触及直径约5cm包块（提示肿块位于升结肠），实验室检查：Hb80g/L（<120g/L，提示轻度贫血），粪隐血（+），根据该患者的临床症状、体征及实验室检查考虑该患者最可能的诊断为升结肠癌（D对），结肠癌主要表现为排便习惯及粪便性状的改变、腹部肿块、腹痛、贫血及乏力等全身症状。十二指肠癌（A错）主要表现为黄疸、消瘦和腹痛。胆囊癌（B错）主要表现为右上腹痛，可放射至肩背部，胆囊管受阻时可触及肿大的胆囊。阑尾类癌（C错）临床表现与急性阑尾炎相似，大多是阑尾切除术中偶然发现。 胰头癌（E错）常见的临床症状是上腹部疼痛、饱胀不适，黄疸，食欲降低和消瘦等。